大黄牡丹汤中除大黄牡丹之外还包括的药物是
A. 厚朴、桃仁、冬瓜仁
B. 枳实、桃仁、冬瓜仁
C. 厚朴、枳实、桃仁
D. 厚朴、枳实、芒硝
E. 桃仁、冬瓜仁、芒硝

正确答案：E。桃仁、冬瓜仁、芒硝

解析：大黄牡丹汤方含大黄、芒硝、冬瓜仁、丹皮、桃仁，可泻热破瘀，散结消肿。方歌：《金匮》大黄牡丹汤，桃仁瓜子芒硝襄，肠痈初起腹按痛，苔黄脉数服之康（E对）。